有关DNA双螺旋结构的叙述，错误的是
A. DNA双螺旋是核酸二级结构的重要形式
B. DNA双螺旋是由两条以脱氧核糖，磷酸做骨架的双链组成
C. DNA双螺旋是以右手螺旋的方式固绕同一轴有规律地盘旋
D. 两股单链从5’到3’端走向在空间排列相同
E. 两碱基之间的氢键是维持双螺旋横向稳定的主要化学键

正确答案：D。两股单链从5’到3’端走向在空间排列相同

解析：DNA双螺旋是核酸二级结构的重要形式（A对），其是由两条以脱氧核糖、磷酸作骨架的双链组成（B对）。两条链围绕着同一螺旋轴形成右手螺旋的结构（C对），它们呈现出反向平行的特征，其中一条链的5＇→3＇方向是自上而下，而另一条链的5＇→3＇方向是自下而上（D错，为本题正确选项）。碱基对的疏水作用力和氢键共同维持着DNA双螺旋结构的稳定，两碱基之间的疏水作用力是用来维持双螺旋纵向稳定，两碱基之间的氢键是维持双螺旋横向稳定的主要化学键（E对）。